切面近边缘有1条棕黄色隆起的木质部环纹或条纹，外表偶有金黄色绒毛残留的饮片是
A. 南沙参
B. 狗脊
C. 赤芍
D. 川芎
E. 百部

正确答案：B。狗脊

解析：本题考查的是狗脊饮片的性状鉴别。切面近边缘有1条棕黄色隆起的木质部环纹或条纹，外表偶有金黄色绒毛残留的饮片是狗脊（B对）。狗脊：【性状鉴别】药材生狗脊片呈不规则长条形或圆形；切面浅棕色，较平滑，近边缘处有1条棕黄色隆起的木质部环纹或条纹，边缘不整齐。偶有金黄色绒毛残留；质脆，易折断，有粉性。饮片烫狗脊片形如生狗脊片，表面略鼓起。棕褐色。气微，味淡、微涩。南沙参（A错）：【性状鉴别】饮片为圆形、类圆形或不规则形厚片。外表皮黄白色或淡棕黄色，切面黄白色，有不规则裂隙。气微，味微甘。赤芍（C错）：【性状鉴别】饮片为类圆形切片。外表皮棕褐色。切面粉白色或粉红色，皮部窄，木部放射状纹理明显，有的具裂隙。川芎（D错）：【性状鉴别】饮片为不规则厚片，外表皮黄褐色或褐色，有皱缩纹。横切片切面黄白色或灰黄色，散有黄棕色小油点，可见明显波状环纹或多角形纹理。纵切片边缘不整齐，呈蝴蝶状，习称“蝴蝶片”，切面灰白色或黄白色，散有黄棕色小油点。质坚实，气浓香，味苦、辛、微甜。百部（E错）：【性状鉴别】饮片呈不规则厚片或不规则的条形斜片。表面灰白色、棕黄色，有深纵皱纹。切面灰白色、淡黄棕色或黄白色，角质样；皮部较厚，中柱扁缩。质韧软。气微，味甘、苦。